属于肝药酶抑制剂药物的是
A. 苯巴比妥
B. 螺内酯
C. 苯妥英钠
D. 西咪替丁
E. 卡马西平

正确答案：D。西咪替丁

解析：本题考查酶的诱导与抑制。西咪替丁（D对）为肝药酶抑制剂，除此之外还有氯霉素、异烟肼、胺碘酮、红霉素、甲硝唑、咪康唑等；苯巴比妥（A错）、螺内酯（B错）、苯妥英钠（C错）、卡马西平（E错）为肝药酶诱导剂。